判别化学物质致癌性所使用的系统不包括
A. 一般毒性试验
B. 短期试验
C. 动物诱癌试验
D. 人类流行病学研究

正确答案：A。一般毒性试验

解析：本题考查判别化学物质致癌性所使用的系统。判别化学物质致癌性所使用的系统包括：定量构-效关系分析、遗传毒性试验、细胞恶性转化试验、短期试验（B对）、动物诱癌试验（C对）、人类流行病学研究（D对）等。一般毒性试验（A错，为本题正确答案）的目的是确定无害作用水平、毒性类型、靶器官、剂量-反应关系，为安全性评价或危险性评价提供重要的资料。